人格的核心是下列哪项
A. 能力
B. 性格
C. 情绪
D. 气质
E. 智力

正确答案：B。性格